女，60岁。反复咳嗽咳痰25年，心悸气促下肢间歇水肿3年，病情加重伴畏寒发热1周入院。体检：T38度，呼吸急促，口唇发绀，双肺叩诊过清音，中下肺闻及湿啰音，心率110次/分，心律齐，无杂音，双下肢重度水肿。为明确诊断首选的检查是
A. 血胆固醇和甘油三酯测定
B. 痰培养及药敏试验
C. 胸部X线检查
D. 动脉血气分析
E. 心电图检査

正确答案：C。胸部X线检查

解析：患者为老年女性，反复咳嗽、咳痰25年（为慢阻肺的典型表现），口唇发绀，双肺叩诊过清音，考虑诊断为慢阻肺（COPD）。心悸、下肢间歇水肿，现发热，双下肢中度水肿，提示右心衰竭，根据其临床表现和体征，考虑诊断为慢阻肺引起的肺心病。肺心病时的X线表现除肺、胸基础疾病及急性肺部感染的特征外，还有肺动脉高压征的表现，其诊断标准如下：①右下肺动脉干扩张，其横径≥15mm或右下肺动脉横径比值≥1.07，或动态观察右下肺动脉干增宽＞2mm；②肺动脉段明显突出或其高度≥3mm；③中心肺动脉扩张和外周分支纤细，形成‘残根’征；④圆锥部显著凸出（右前斜位45°）或者其高度≥7mm；⑤右心室增大。具有上述任一条均可诊断肺心病，故最佳答案为胸部X线检查（C对）。血胆固醇和甘油三酯测定（A错）、痰培养及药敏试验（B错）对COPD及肺心病确诊的价值不大。动脉血气分析（D错）用于了解病情严重程度和诊断呼吸衰竭，多在病人昏迷、病情危重的情况下使用。右心肥大时心电图检査（E错）虽可有征象，但对慢性肺心病的诊断阳性率为60.1%～88.2%，且肺动脉增宽时无征象，与胸部X线检查相比不是最佳答案。